关于恒牙的萌出顺序，下列说法错误的是
A. 第一恒磨牙萌出最早，又称为“六龄牙”
B. 除第三磨牙外，第二恒磨牙萌出最晚
C. 在六龄牙萌出后，切牙开始萌出
D. 上颌牙齿萌出顺序有差异的为侧切牙和第一前磨牙
E. 下颌牙齿萌出顺序有差异的为尖牙与第一前磨牙

正确答案：D。上颌牙齿萌出顺序有差异的为侧切牙和第一前磨牙

解析：恒牙萌出顺序也有一定规律：上颌多为6→1→2→4→3→5→7或6→1→2→4→5→3→7；下颌多为6→1→2→3→4→5→7或6→1→2→4→3→5→7。掌握“牙的萌出、更替及牙体解剖名词、标志”知识点。